应激时机体各种机能和代谢变化的发生基础主要是
A. 神经内分泌反应
B. 免疫反应
C. 急性期反应
D. 热休克反应
E. 适应性反应

正确答案：A。神经内分泌反应

解析：神经内分泌反应（A对）是应激时机体各种机能和代谢变化的主要发生基础。